张某，建筑工人。工作期间突然发病，高热，大量出汗，随后皮肤干热，伴有意识障碍和昏迷等中枢神经系统症状。测量工地发现WBGT指数39℃。以下最有效的措施是
A. 采取措施迅速降低体温
B. 及时口服含盐清凉饮料
C. 纠正水、电解质紊乱
D. 葡萄糖生理盐水静脉滴注
E. 注射糖皮质激素

正确答案：A。采取措施迅速降低体温